常用于股疝修补的手术方法是
A. Bassini法
B. Ferguson法
C. McVay法
D. Shouldice法
E. Halsted法

正确答案：C。McVay法

解析：股疝最常用的手术是McVay修补法（C对）。Bassini法、Shouldice法、Halsted法是加强或修补腹股沟管后壁的方法（ADE错）。Ferguson法是加强或修补腹股沟管前壁的方法（B错）。